患者，男性，58岁。有肺癌病史，症见咳嗽痰少，神疲乏力，纳差腹胀，口干喜饮，盗汗，大便干结，舌质红，脉细弱。可选用下列哪种方剂
A. 血府逐瘀汤
B. 导痰汤
C. 六君子汤
D. 六味地黄汤
E. 生脉散

正确答案：E。生脉散

解析：脾气亏虚，不能运化故见神疲乏力，纳差腹胀，脉弱；阴虚肺燥故见咳嗽痰少，口干喜饮；阴虚内热，蒸液外出故见盗汗；阴虚不能濡养肠道故见大便干结；舌质红，脉细为均气阴两虚之象；治疗当采用补气养阴之法，选用生脉散（E对）治疗。血府逐瘀汤（A错）具有活血化瘀功效。导痰汤（B错）具有燥湿祛痰，行气开郁功效，治疗痰湿郁肺证。六君子汤（C错）具有健脾止呕功效，治疗脾气亏虚证。六味地黄汤（D错）具有滋补肾阴功效，用于治疗肾阴亏虚证。